痰停哪个部位可引起眩晕
A. 心
B. 肺
C. 头
D. 咽
E. 胃

正确答案：C。头

解析：痰浊为病，随气上逆，尤易蒙蔽清窍（头），扰乱心神，使心神活动失常，出现头晕目眩（C对）、精神不振等症。若痰浊痹阻心脉，血气运行不畅，可见胸闷心痛（A错）。痰饮阻肺，肺气失于宣降，则见胸闷气喘、咳嗽吐痰等（B错）。痰气凝结咽喉，可出现咽中梗阻，吞之不下，吐之不出，称为梅核气（D错）。痰停于胃，胃失和降，则胃脘痞满，恶心呕吐痰涎（E错）。